生首乌的功效有
A. 润肠
B. 截疟
C. 止汗
D. 解毒
E. 补气血

正确答案：A、B、D。润肠；截疟；解毒

解析：本题考查的是何首乌的性能特点。生首乌的功效有润肠（A对）、截疟（B对）与解毒（D对）。何首乌：【性能特点】本品入肝、肾经，制用、生用性效有别。制用微温，甘补兼涩，不腻不燥，善补肝肾、益精血、乌须发，为滋补良药，善治精血不足证。生用平而偏凉，苦多甘少，善行泄而补虚力弱，能解毒、截疟、润肠燥，治疮肿瘰疬、体虚久疟、肠燥便秘。【功效】补益精血，解毒，截疟，润肠通便。白芍：【功效】养血调经，敛阴止汗（C错），柔肝止痛，平抑肝阳。紫河车：【性能特点】本品甘咸温补而不燥热，入肺、肝、肾经，为平补气血精阳之品。既温肾助阳、补肺益气，又补精养血、气血同调（E错），善治肺肾亏虚、精血不足、气血两亏等证。